对β-内酰胺酶有较高的稳定性的
A. 第一代头孢菌
B. 第二代头孢菌
C. 第三代头孢菌
D. 青霉素类
E. 红霉素

正确答案：C。第三代头孢菌

解析：第三代头孢菌素对G+菌的作用不及第一、第二代，对G-菌包括肠杆菌类、铜绿假单胞菌及厌氧菌有较强的作用。对β-内酰胺酶有较高的稳定性。可用于危及生命的败血症、脑膜炎、肺炎、骨髓炎及尿路严重感染的治疗，能有效控制严重的铜绿假单胞菌感染。掌握“青霉素及头孢菌素类药”知识点。